女，23岁，新婚，月经规律，经量较多，尚无生育计划。最应该建议的避孕方法是
A. 复方短效口服避孕药
B. 宫内节育器
C. 长效避孕针
D. 安全期避孕
E. 体外排精

正确答案：A。复方短效口服避孕药

解析：女，23岁，新婚，且经量过多，复方短效口服避孕药使用方便，避孕效果好，不影响性生活，并且对经量过多有一定的治疗作用，列为首选（A对）。男用阴茎套也是比较理想的避孕方法，性生活适应后可选用阴茎套。还可选用外用避孕栓，薄膜等。由于尚未生育，一般不选用宫内节育器（B错）。不适宜用安全期，体外排精及长效避孕药（CDE错）。